真核生物中tRNA和5SrRNA的转录由下列哪一种酶催化
A. RNA聚合酶I
B. 逆转录酶
C. RNA聚合酶Ⅱ
D. RNA聚合酶全酶
E. RNA聚合酶Ⅲ

正确答案：E。RNA聚合酶Ⅲ

解析：RNA聚合酶Ⅲ位于核仁外，催化转录编码tRNA、5SrRNA和小RNA分子的基因。掌握“RNA的生物合成”知识点。